《学校卫生工作条例》是发布时间是
A. 1990年6月4日
B. 1990年4月25日
C. 1989年6月4日
D. 1991年4月25日
E. 1990年8月13日

正确答案：A。1990年6月4日